肿瘤细胞形成小管状或条索状结构；内层衬有导管细胞，外层为肌上皮细胞，此为腺样囊性癌的哪种分型
A. 腺性型
B. 包膜型
C. 管状型
D. 黏液型
E. 实性型

正确答案：C。管状型

解析：本题考查腺样囊性癌的组织类型。肿瘤细胞形成小管状或条索状结构；内层衬有导管细胞，外层为肌上皮细胞，此为腺样囊性癌的管状型（C对）。管状型腺样囊性癌的主要特点是：以肿瘤细胞形成小管状或条索状结构为主；管状结构的内层衬有导管细胞，外层为肿瘤性肌上皮细胞。